女，60岁。一周前家人发现晨起不能唤醒，急诊查血糖2.1mmol/L。既往无糖尿病病史。查体：BP120/85mmHg，心率105次/分，BMI32。此时，该患者最有可能异常的激素是
A. 胰岛素
B. 生长激素
C. 胰高血糖素
D. 糖皮质激素
E. 甲状腺激素

正确答案：A。胰岛素

解析：老年女性患者，出现晨起意识障碍，查血糖2.1mmol/L，可诊断为低血糖症。患者晨起时出现低血糖症，为空腹低血糖症，其主要病因是不适当的高胰岛素血症，因此该患者最有可能异常的激素是胰岛素（A对）。生长激素（B错）、胰高血糖素（C错）、糖皮质激素异常（D错）、甲状腺激素（E错）异常均非空腹低血糖症的原因。